环糊精包合物常用的制备方法有
A. 饱和水溶液法
B. 研磨法
C. 冷冻干燥法
D. 喷雾干燥法
E. 相溶解度法

正确答案：A、B、C、D。饱和水溶液法；研磨法；冷冻干燥法；喷雾干燥法